男孩，4岁。母亲拉其右手上楼梯时突然出现哭闹，右上肢不敢活动。查体：右前臂半屈及旋前位，活动受限，未见明显畸形。X线片未见明显异常。最可能的诊断是
A. 肱骨外上髁炎
B. 肘关节脱位
C. 肩关节脱位
D. 桡骨头半脱位
E. 尺骨青枝骨折

正确答案：D。桡骨头半脱位

解析：患者男孩，4岁，有右手向上牵位的受伤史（提示桡骨头半脱位），右上肢疼痛不敢活动，前臂半屈及旋前位，活动受限，未见明显畸形，X线片未见明显异常，可以诊断为桡骨头半脱位（D对）。肱骨外上髁炎（网球肘）（A错），在前臂过度旋前或旋后位，被动牵拉伸肌（握拳、屈腕）和主动收缩伸肌（伸腕）将对肱骨外上髁处的伸肌总腱起点产生较大张力，如长期反复这种动作即可引起该处慢性损伤，常见于网球、羽毛球运动员，厨师等（P719）。上肢外伤后，肘部疼痛、肿胀、活动障碍，肘后三角关系发生改变，应考虑为肘关节脱位（B错）（P637）。肩关节脱位（C错）有上肢外展外旋或后伸着地受伤史，肩部疼痛、肿胀、肩关节活动障碍，检查可发现患肩呈方肩畸形，肩胛盂处有空虚感，上肢有弹性固定（P631）。尺骨青枝骨折（E错）多见于儿童，骨质和骨膜部分断裂，可有成角畸形，属于不完全骨折，无手、腕向上牵拉受伤史。